RPA卡环组要求基牙排列正常，为了获得颊面近、远中两个倒凹区，观测线位于
A. 牙冠的顶部
B. 牙冠的底部
C. 牙冠的中部
D. 牙冠平齐
E. 牙冠表面

正确答案：C。牙冠的中部

解析：RPA卡环组要求基牙排列正常，观测线位于牙冠的中部，以便获得颊面近、远中两个倒凹区。卡环臂的坚硬部分应与颊面观测线重合，既不能高于观测线位于非倒凹区，也不能低于观测线位于倒凹区。以便当游离端基托下沉时，颊侧卡环臂能够像RPI卡环的I杆一样，向龈方移动，与基牙脱离接触。如果固位臂高于观测线且横过牙冠中部，最后进入倒凹区，则当游离端下沉时卡环臂位于观测线上方非倒凹区的部分将形成支点，使基牙受到向远中的扭力。当然，颊侧卡环臂除卡环臂尖以外也不能位于观测线龈方的倒凹区内，以免影响就位。掌握“局部义齿固位体”知识点。